患者，男，18岁。昨日饱餐后出现胃脘胀痛，嗳腐吞酸，大便不爽，舌苔厚腻，脉弦滑。治疗应首选
A. 保和丸
B. 失笑散
C. 逍遥散
D. 金铃子散合小柴胡汤
E. 良附丸

正确答案：A。保和丸

解析：题中患者以胃脘胀痛为主症，故诊断为胃痛。饱餐后，饮停食滞，致胃中气机阻塞，故胃脘胀痛；健运失司，腐熟无权，谷浊之气不得下行而上逆，所以嗳腐吞酸；胃中饮食停滞，导致肠道传导受阻，故大便不爽；舌苔厚腻，为食滞之象；脉弦滑为宿食之征。故诊断为胃痛饮食伤胃证，治宜消食导滞，和胃止痛，方选：保和丸加减（A对）。失笑散功能活血化瘀，为治疗胃痛瘀血停胃证的选方（B错）。逍遥散功能疏肝解郁，健脾养血，为治疗积聚肝气郁结证选方（C错）。金铃子散功能疏肝泄热，活血止痛，可治疗肝郁化火证；小柴胡汤功能和解少阳，为治疗淋证之热淋伴见寒热、口苦呕恶者的选方（D错）。良附丸功能温胃散寒，理气止痛，为治疗胃痛寒邪客胃证的选方（E错）。